失去细胞壁的细菌发生融合，获得多种类型重组融合体，称为
A. 转化
B. 转导
C. 溶原性转换
D. 接合
E. 原生质体融合

正确答案：E。原生质体融合